用于治疗绿脓杆菌感染的药物
A. 氯霉素
B. 青霉素
C. 羧苄青霉素
D. 四环素
E. 利福平

正确答案：C。羧苄青霉素

解析：本题考查氨苄青霉素。羧苄青霉素（C对）可用于绿脓杆菌感染。氯霉素（A错）是敏感菌株所致伤寒、副伤寒的首选药物。青霉素（B错）适用于革兰阳性球菌所致的感染以及破伤风、气性坏疽、流行性脑脊髓膜炎、鼠咬热、梅毒、淋病。四环素（D错）高浓度时具杀菌作用。利福平（E错）对结核分枝杆菌和部分非结核分枝杆菌（包括麻风分枝杆菌等）在宿主细胞内外均有明显的杀菌作用；对需氧革兰阳性菌具良好抗菌作用。